手外伤的术后处理不正确的是
A. 抬高患肢防止肿胀
B. 注射破伤风抗毒血清
C. 将桡茎突部的敷料剪开
D. 术后用石膏托将手固定于伸直位
E. 包扎时用纱布隔开手指同时露出指尖

正确答案：D。术后用石膏托将手固定于伸直位

解析：手外伤如有关节破坏，日后常难以恢复活动功能，故术后应将手固定于功能位（D错，为本题正确答案），这样可使伤手保持最大的功能。手外伤后，抬高患肢，可增加血液回流，可防止和减轻手部肿胀（A对），利于伤后恢复。手外伤后应常规应用破伤风抗毒血清（B对），以预防破伤风。剪开桡骨茎突部位的敷料，以免局部受压皮肤坏死（C对）。包扎手部时，应用纱布隔开手指同时露出指尖，以便观察末梢血运（E对）和防止手指粘连。